与水液代谢关系最密切的脏腑是
A. 脾胃肝
B. 肝胆肾
C. 肝肺脾
D. 肺肾脾
E. 心肾肺

正确答案：D。肺肾脾

解析：津液代谢是一个复杂的生理过程，与肺、脾、肾三脏的功能密切相关。肺气的宣发将脾转输至肺的津液，向上向外布散，上至头面诸窍，外达皮毛腠理，并化为汗液排出体外。肺气的肃降，将脾转输至肺的津液，向下向内输送至其他脏腑，并将各脏腑代谢后产生的浊液下输膀胱，成为尿液生成之源。脾主运化水液，途径有四：一是上输于肺，通过肺气宣降输布全身；二是向四周散布，发挥其滋养濡润脏腑的作用；三是将胃、小肠、大肠中的部分水液经过三焦下输膀胱，成为尿液生成之源；四是居中枢转津液，使全身津液随脾胃之气的升降而上腾下达。肾气对参与津液代谢的脏腑都有促进作用；肾气能蒸化水液，使其清者经脾达肺，重新参与代谢，浊者留而为尿；膀胱排泄尿液，依赖肾阴的抑制和肾阳的推动的平衡，肾气蒸化和固摄作用的协调（D对）。